下面哪项不是流行病学实验研究的基本特点
A. 前瞻性研究
B. 须施加干预措施
C. 随机分组
D. 其结果可计算出OR值
E. 有实验组和对照组

正确答案：D。其结果可计算出OR值